具有免疫调节作用的驱虫药物是
A. 盐酸左旋咪唑
B. 吡喹酮
C. 乙胺嘧啶
D. 磷酸氯喹
E. 甲硝唑

正确答案：A。盐酸左旋咪唑

解析：本题考查盐酸左旋咪唑。具有免疫调节作用的驱虫药物是盐酸左旋咪唑（A对）。左旋咪唑为四咪唑的左旋体，可选择性地抑制虫体肌肉中的琥珀酸脱氢酶，使延胡索酸不能还原为琥珀酸，从而影响虫体肌肉的无氧代谢，减少能量产生，同时当虫体与之接触时，能使神经-肌肉去极化，肌肉发生持续收缩而致麻痹，有利于虫体的排出。左旋咪唑还有免疫调节和免疫兴奋功能。吡喹酮（B错）为抗血吸虫病药。乙胺嘧啶（C错）、磷酸氯喹（D错）为抗疟药。甲硝唑（E错）为抗阿米巴病药。